肾小球疾病最主要的发病机制是
A. 肾小球高灌注
B. 高血压
C. 过敏反应
D. 血脂异常
E. 免疫异常

正确答案：E。免疫异常

解析：肾小球疾病最主要的发病机制是免疫异常（E对）。免疫介导性炎症在肾小球病致病中起主要作用和（或）起始作用，非免疫机制包括肾小球毛细血管内高压力（A错）、蛋白尿、高脂血症（D错）等亦在疾病发生发展中起到一定作用（P465）。